哌唑嗪的不良反应可表现为
A. 低血钾
B. 消化性溃疡
C. 水钠潴留
D. 粒细胞减少
E. 首剂低血压

正确答案：E。首剂低血压